男性，65岁，吸烟40余年，慢性咳嗽，咳痰20余年。近2年来劳累时有气急。查体：两肺呼吸音减弱，肺下界下移。两肺底有细小湿啰音。最可能的诊断是
A. 大叶性肺炎
B. 肺气肿
C. 胸腔积液
D. 支气管哮喘
E. 气胸

正确答案：B。肺气肿

解析：患者为老年男性，有吸烟史（为重要的环境发病因素），慢性咳嗽，咳痰20余年，近2年来劳累时有气急，提示慢性支气管炎。慢性支气管炎+两肺呼吸音减弱，肺下界下移，两肺底有细小湿啰音，提示患者存在肺气肿（B对）（已发展成慢阻肺可能性较大）。大叶性肺炎（A错）起病急骤、寒战高热，实变时肺部叩诊浊音，触觉语颤增强，可闻及支气管呼吸音等，自然病程1～2周，与本病例明显不符。胸腔积液（P115）（C错）时呼吸困难多伴有胸痛和咳嗽，可有胸膜摩擦音，触觉语颤减弱，局部叩诊浊音，呼吸音减低或消失，气管向健侧移位等体征。支气管哮喘（P29）（D错）具有反复发作性，发作时可闻及双肺弥漫性哮鸣音，呼气音延长，症状可在数分钟内发生，持续数小时至数天，可经平喘药治疗或自行缓解，与本病例不符。气胸（P120）（E错）多数起病急骤，突感一侧胸痛，且除呼吸音减弱或消失之外，多有呼吸运动与触觉语颤减弱，叩诊呈鼓音等，与本病例不符。